男，28岁。枕部着地，昏迷5分钟后清醒，并自己回到家中，其后出现头痛并逐渐加重伴呕吐，1小时后不省人事，急送医院。查体：BP160/90mmHg，脉率65次/分，呼吸15次/分。浅昏迷，右枕部头皮挫伤，左侧脑孔4mm，对光反应消失；右侧瞳孔2.5mm，对光反应存在。最适当的检查方法是
A. 头颅超声检查
B. 脑电图
C. 头颅MRI
D. 头颅X线片
E. 头颅CT

正确答案：E。头颅CT

解析：为明确诊断，最适当的检查方法为头颅CT（E对），CT不仅可以直接显示硬膜外血肿，表现为颅骨内板与硬脑膜之间的双凸镜形或弓形高密度影，还可了解脑室受压和中线结构移位的程度及并存的脑挫裂伤、脑水肿等情况，对硬膜外血肿的诊断和治疗具有重要意义。超声通过致密的颅骨时，衰减值极大，导致颅骨后方声波减弱乃至消失，出现声影，因而头颅超声检查（A错）对颅内结构的显像效果不佳，一般不用。脑电图（B错）适用于癫痫、精神性疾病的诊断，对颅内血肿的诊断意义不大。头颅MRI（C错）对颅内软组织的显示效果较好，多用于颅内肿瘤的诊断，其检查时间长，不适用于颅内血肿等急性病例。头颅X线片（D错）主要用于颅骨骨折的诊断，不能确诊颅内血肿。